所谓阴离子间隙是指
A. 细胞内阴离子与阳离子之差
B. 细胞外阴离子与阳离子之差
C. 细胞内外的阴离子与阳离子之差
D. 血浆中未测定的阴离子与未测定的阳离子之差
E. 血浆中未测定的阳离子与未测定的阴离子之差

正确答案：D。血浆中未测定的阴离子与未测定的阳离子之差

解析：阴离子间隙是指血浆中未测定的阴离子与未测定的阳离子之差（D对）。